下列选项中不是大众传播的特点的是
A. 必须遵守相应的文化和政治规则
B. 信息扩散距离远、速度快、覆盖面广
C. 信息是公开的、公共的、面向全社会人群
D. 需要借助一定的传播技术手段
E. 任何人都可以是传播者

正确答案：E。任何人都可以是传播者